患者，女，右上颌67缺失，一年前行右上颌4567固定桥修复，现右上45松动，牙周组织炎症，主要原因是
A. 牙髓炎
B. 继发性龋
C. 电位差刺激
D. 咬合早接触
E. 基牙受力过大

正确答案：E。基牙受力过大

解析：基牙受力过大：固定桥设计不合理，如缺牙数目多或基牙承受（牙合）力的能力差，使桥基牙持续承受超越其能承受限度的负荷，引起牙周组织炎症，基牙疼痛，此时必须摘除固定桥，重作牙列缺损的修复设计。掌握“固定桥修复后出现的问题及处理”知识点。